感染HBV后出现保护性抗体的标志是
A. HBsAg阳性
B. HBeAg阳性
C. 抗-HBe阳性
D. 抗-HBc阳性
E. 抗-HBs阳性

正确答案：E。抗-HBs阳性

解析：成人感染HBV后最早1～2周、最迟11～12周，外周血中可检测到HBsAg；无症状携带者和慢性患者HBsAg可持续存在多年，甚至终身存在。HBsAg只有抗原性，无传染性。乙型肝炎表面抗体是一种保护性抗体，HBsAb 阳性表示对HBV有免疫力（E对），见于乙型肝炎恢复期、既往感染及乙肝疫苗接种后。